“无痰不作眩”，出自的医著是
A. 《素问·六元正纪大论》
B. 《金匮要略》
C. 《丹溪心法》
D. 《景岳全书》
E. 《医学正传》

正确答案：C。《丹溪心法》

解析：《素问·六元正纪大论》云“木郁之发…甚则耳鸣眩转”（A错）。《金匮要略·痰饮咳嗽病脉证并治》说：“心下有支饮，其人苦冒眩，泽泻汤主之（B错）。《丹溪心法·头眩》中则强调“无痰则不作眩”（C对）。《景岳全书·眩运》篇中指出：“眩运一证，虚者居其八九，而兼火兼痰者，不过十中一二耳”（D错）。《医学正传·眩运》言：“大抵人肥白而作眩者，治宜清痰降火为先，而兼补气之药；人黑瘦而作眩者，治宜滋阴降火为要，而带抑肝之剂”（E错）。